在有机磷杀虫农药中毒时，可选用的抢救药是
A. 二巯基丙醇
B. 依地酸钙钠
C. 硫酸阿托品
D. 硫代硫酸钠
E. 盐酸烯丙吗啡

正确答案：C。硫酸阿托品

解析：本题考查有机磷中毒解救。在有机磷杀虫农药中毒时，可选用的抢救药是硫酸阿托品（C对）。有机磷农药中毒最主要的救治原则是清除毒物、特效解毒剂的应用、对症支持治疗,及早洗胃也可以减少毒物的吸收,早期合理应用特效解毒剂,包括阿托品、氯解磷定、碘解磷定等。二巯丁二钠（A错）用于锑、铅、汞、砷的中毒，并预防镉、钴、镍的中毒。依地酸钙钠（B错）用于铅、锰、铜、镉等中毒，尤以铅中毒疗效好，也可用于镭、钚、铀、钍中毒。硫代硫酸钠（D错）主要用于氰化物中毒，也用于砷、汞、铅中毒等。盐酸烯丙吗啡（E错）用于阿片类药物急性中毒。